性病淋病肉芽肿的病原体是
A. 人乳头瘤病毒
B. 沙眼衣原体
C. 苍白螺旋体
D. 淋病奈瑟菌
E. 纤细螺旋体

正确答案：B。沙眼衣原体

解析：本题考查常见性传播疾病及其病原体。性病淋病肉芽肿的病原体是沙眼衣原体（B对ACDE错），主要相关疾病有：溃疡、腹股沟肿胀、直肠炎。